胃十二指肠溃疡手术的绝对适应证是
A. 瘢痕性幽门梗阻
B. 胃十二指肠溃疡大出血
C. 胃十二指肠溃疡急性穿孔
D. 十二指肠溃疡并球部变形
E. 穿透性十二指肠溃疡

正确答案：A。瘢痕性幽门梗阻

解析：幽门梗阻可分为痉挛性、炎症水肿性和瘢痕性三种类型。瘢痕性幽门梗阻常由于胃幽门、幽门管或十二指肠球部溃疡反复发作所致，是永久性的、不可逆的，需要外科手术才能解除，因此胃十二指肠手术的绝对适应证是瘢痕性幽门梗阻（A对）。胃十二指肠溃疡大出血（B错）、胃十二指肠溃疡急性穿孔（C错）、穿透性十二指肠溃疡（E错）为胃十二指肠溃疡手术的相对适应证。十二指肠的溃疡患者常伴有球部变形，经抑酸、抗感染等保守治疗后多可好转，不是胃十二指肠溃疡手术的适应证（D错）。